经胃管肠内营养时，判断胃潴留发生的标准是在每次输营养液30分钟后，回抽量应至少大于
A. 100ml
B. 200ml
C. 150ml
D. 50ml
E. 250ml

正确答案：C。150ml

解析：进行肠内营养时，输营养液30分钟后，回抽量大于150ml（C对），考虑有胃潴留存在，应暂停胃管灌注，以防止误吸。